男性，60岁。上腹痛，食欲减退，持续黑便1月余。查体：上腹触及肿块。应首先考虑的是
A. 胃癌
B. 胃溃疡
C. 慢性萎缩性胃炎
D. 胃原发性淋巴瘤
E. 食管癌

正确答案：A。胃癌

解析：患者中年男性，上腹痛，食欲减退，持续黑便1月余（提示长期消化道出血），上腹能触及肿块（提示肿瘤性疾病），应首先考虑的是胃癌（A对）。胃溃疡（P370）（B错）的疼痛呈周期性发作，发作时剑突下有局限性压痛，但触诊无肿块。慢性萎缩性胃炎（P366）（C错）的症状、体征均不明显，有时仅表现为上腹轻压痛。胃原发性淋巴瘤（八版外科学P365）（D错）的临床表现与胃癌相似，但发病率较胃癌低，故不首先考虑。食管癌（P361）（E错）的典型表现为进行性吞咽困难，疼痛多位于胸骨后，常于吞咽食物时加重。